男，8个月。持续高热频咳，精神萎靡5天，近2天气促加重，今抽搐3次全身性发作嗜睡。查体：体温40℃，呼吸54次/分，心率148次/分，双肺少量湿啰音，左下肺闻及管状呼吸音，肝肋下1cm，白细胞计数明显升高。X线显示大小不等的片状病灶或融合性病灶，以两肺下野及右上肺多见。若患儿突然发生少尿，尿钠40mmol/L，尿沉渣出现棕色颗粒。最有可能出现的情况是
A. 败血症
B. 心力衰竭
C. 肾前性少尿
D. 尿路梗阻
E. 急性肾衰

正确答案：E。急性肾衰

解析：患儿突发少尿，尿钠40mmol/L、尿沉渣出现棕色颗粒提示出现肾性肾衰（E对）。败血症（A错）有黄疸、出血等表现。心力衰竭（B错）出现少尿前有端坐呼吸、水肿等表现。肾前性少尿（C错），即肾前性肾衰时尿钠＜20mmol/L。尿路梗阻（D错）时不会出现前述肾衰表现。